消化性溃疡并发出血时，首选的治疗药物是
A. 止血环酸
B. 法莫替丁
C. 奥美拉唑
D. 垂体后叶素
E. 维生素K

正确答案：C。奥美拉唑

解析：消化性溃疡并发出血，止血措施主要有：抑制胃酸分泌；内镜治疗；介入治疗（P452）。抑制胃酸分泌首选PPI（质子泵抑制剂）如奥美拉唑静脉途径给药（C对）。止血环酸（A错）主要用于急性或慢性、局限性或全身性纤维蛋白溶解亢进所致的各种出血。法莫替丁（B错）属于H₂受体拮抗剂，不作为首选。垂体后叶素（D错）用于主要用于呼吸内科的咯血和产后出血，不用于消化性溃疡并发出血时止血。维生素K（E错）可以促进凝血因子Ⅱ、Ⅶ、Ⅸ、Ⅹ的合成，起效慢，不用于消化性溃疡并发出血的止血。